婚前卫生指导主要包括
A. 遗传病的基本知识
B. 有关性卫生的保健和教育
C. 新婚避孕知识及计划生育指导
D. 其他生殖健康知识
E. 以上说法均正确

正确答案：E。以上说法均正确

解析：婚前卫生指导　是指关于性卫生知识、生育知识和遗传病知识的教育。主要包括：①有关性卫生的保健和教育；②新婚避孕知识及计划生育指导；③受孕前的准备、环境和疾病对后代影响等孕前保健知识；④遗传病的基本知识；⑤影响婚育的有关疾病的基本知识；⑥其他生殖健康知识。掌握“母婴保健法及其实施办法”知识点。